女，32岁。发热伴乏力、胸痛、气促1周。查体：体温38摄氏度，右下肺叩诊实音，淋巴0.82，总蛋白35g/L，LDH300U/L。最可能的诊断是
A. 肺结核
B. 自发性气胸
C. 结核性胸膜炎
D. 肺炎
E. 肺血栓栓塞症

正确答案：C。结核性胸膜炎

解析：该患者为青年女性，胸痛，气促，右下肺叩诊实音（为胸腔积液的典型表现和体征），可初步确诊该患者存在胸腔积液。胸腔积液检查淋巴细胞增多（淋巴细胞正常百分比为0.2～0.4），总蛋白含量增高（白蛋白正常范围为35-50g/L），LDH含量也增高（LDH正常范围为＜200U/L）可判断胸水为炎性渗出液，结合患者为青年女性，有全身症状（发热），可初步诊断为结核性胸膜炎（C对）。肺结核（P65）（A错）多表现为咳嗽、咳痰，结核病灶累及胸膜时才表现胸痛，X线可见肺典型部位的炎性浸润。自发性气胸（P119）（B错）多在持重物等诱因下，突发胸痛，呼吸音减弱，叩诊呈清音。肺炎（P42）（D错）表现为咳嗽、咳痰，多为细菌感染，所以白细胞和中性粒细胞会明显增高，淋巴细胞增高不明显。肺血栓栓塞症（P98）（E错）表现为突发性胸痛、呼吸困难，咯血，胸部CT可以确诊。